慢性左心衰最早出现的症状是
A. 咳嗽、咳痰、咳血
B. 夜间阵发性呼吸困难
C. 劳力性呼吸困难
D. 端坐呼吸
E. 心悸、乏力

正确答案：C。劳力性呼吸困难

解析：慢性左心衰，左心功能减退，运动使回心血量增加，左心房压力升高，加重肺淤血最早出现劳力性呼吸困难（C对）。当肺淤血达到一定程度时，患者不能平卧，出现端坐呼吸（D错），因平卧时回心血量增多且横膈上抬，呼吸更为困难；随病情进展，出现夜间阵发性呼吸困难（B错）；咳嗽、咳痰（A错）是肺泡和支气管粘膜瘀血所致，白色浆液性泡沫痰为其特征，偶可见痰中带血丝，急性左心衰发作时可出现粉红色泡沫样痰；心悸、乏力（E错）是器官、组织灌注不足及代偿性心率加快所致的症状，出现较劳力性呼吸困难晚。